上颌骨骨折诊断中最有决定意义的症状是
A. 几个牙齿折断或错位
B. 鼻孔大出血
C. 面部肿胀
D. 上颌骨出现动度和错（牙合）
E. 脑震荡

正确答案：D。上颌骨出现动度和错（牙合）

解析：本题考查上颌骨骨折诊断中最有决定意义的症状。颌骨骨折中，咬合错乱是最重要最常见的骨折症状，对颌骨骨折的诊断治疗有重要意义（D对）。个别牙齿折断或错位在颌骨骨折中不具有决定性诊断意义（A错）。当上颌骨骨折合并口、鼻腔黏膜撕裂或鼻旁窦黏膜损伤可能会伴发鼻孔大出血（B错）。面部肿胀为软组织损伤的表现（C错）。脑震荡是头面部外伤后即刻发生的短暂性意识障碍，属于轻度脑损伤（E错）。